服药期间饮茶可降低疗效的药品是
A. 格列本脲
B. 硫酸亚铁
C. 维生素D
D. 西咪替丁
E. 左旋多巴

正确答案：B。硫酸亚铁

解析：本题考查饮食对药物疗效的影响。硫酸亚铁（B对）中的铁离子可与茶叶中的鞣酸结合而生成沉淀，从而影响药物吸收。格列本脲（A错）为磺酰脲类促胰岛素分泌药物，服药期间饮茶不会出现明显的降低疗效作用。维生素D（C错）为固醇类衍生物，服用维生素D期间饮茶不会出现明显的降低疗效作用。西咪替丁（D错）为抑酸剂，服用西咪替丁期间饮茶不会出现明显的降低疗效作用。左旋多巴（E错）通过血脑屏障进入脑组织发挥作用，服用左旋多巴期间饮茶不会明显降低疗效。